痹症属着痹者，治疗除主穴外，还应选取的配穴是
A. 膈腧 血海
B. 肾俞 关元
C. 阴陵泉 足三里
D. 大椎 曲池
E. 脾俞 胃俞

正确答案：C。阴陵泉 足三里

解析：着痹加阴陵泉、足三里（C对）。行痹加膈腧、血海（A错）。痛痹加肾俞、腰阳关（B错）。热痹加大椎、曲池（D错）。脾俞、胃俞不能治疗痹症（E错）。